口腔科器械消毒常用以下几种灭菌法不包括
A. 压力蒸汽灭菌
B. 干热消毒灭菌
C. 环氧乙烷气体灭菌
D. 氧化乙烯灭菌系统
E. 紫外线灭菌

正确答案：E。紫外线灭菌

解析：口腔科常用以下几种灭菌法：①压力蒸汽灭菌；②干热消毒灭菌；③环氧乙烷气体灭菌；④氧化乙烯灭菌系统；⑤低温过氧化氢等离子灭菌系统。其中先进行抽真空的压力蒸汽灭菌法是目前口腔领域首选和最有效的灭菌方法。紫外线灭菌多用于诊室消毒灭菌。掌握“口腔器械的消毒与灭菌及医疗废物处理”知识点。